治疗肠蛔虫病的主要方法是
A. 驱蛔杀虫
B. 散结下虫
C. 安蛔定痛
D. 调理脾胃
E. 通腑排蛔

正确答案：A。驱蛔杀虫

解析：蛔虫病总的治疗原则为驱蛔杀虫，调理脾胃（A对D错）。出现蛔厥证时先安蛔定痛，继以驱蛔杀虫（C错）。虫瘕证宜通腑散结，驱蛔下虫（BE错）。